既能保护滋润皮肤，还能软化附着物，促使药物渗透到皮肤深部而起作用
A. 洗剂
B. 糊剂
C. 酊剂
D. 搽剂
E. 贴剂

正确答案：C。酊剂

解析：本题考查酊剂。酊剂（C对）既能保护滋润皮肤，还能软化附着物，促使药物渗透到皮肤深部而起作用。